下列哪种疾病主要表现为进行性的锥体外系功能障碍的中枢神经系统退行性疾病
A. 骨质疏松
B. 神经衰弱
C. 癫痫病
D. 中枢性咳嗽
E. 帕金森病

正确答案：E。帕金森病

解析：帕金森病（PD）又称震颤麻痹，是一种主要表现为进行性的锥体外系功能障碍的中枢神经系统退行性疾病。掌握“左旋多巴、卡比多巴、苯海索”知识点。